成人阑尾炎切除术后1天出现烦躁、剧烈腹痛，心率112次/分，血压90/60mmHg，腹胀、全腹压痛，肠鸣音弱，为除外腹腔内出血首要的检查是
A. B超
B. CT
C. MRI
D. 腹腔穿刺
E. 立位腹平片

正确答案：D。腹腔穿刺

解析：患者阑尾炎切除术后1天，烦躁，心率112次/分，血压90/60mmHg，腹胀、腹痛，全腹压痛，肠鸣音弱，可考虑为腹腔内出血或阑尾周围渗液、术中清洗液残留腹腔。此时首要的检查是腹腔穿刺（D对），如穿刺抽得不凝血即为腹腔内出血，抽得其他性质液体可除外腹腔内出血。相比之下，B超（A错）、CT（B错）、MRI（C错）、立位腹平片（E错）价格高、操作复杂、不能直观判断积液性质，故不作为首选。